应激性溃疡出血时错误的治疗是
A. 使用H₂受体拮抗剂
B. 使用胃黏膜保护剂
C. 经胃管灌注止血药物
D. 胃镜下止血治疗
E. 行胃壁切开电灼止血

正确答案：E。行胃壁切开电灼止血

解析：应激性溃疡出血时的治疗包括：内镜下止血，经胃管或选择性腹腔动脉插管注入垂体后叶素或其它血管收缩剂、生长抑素、抑制胃酸分泌的药物。非手术治疗无效时，可以采用止血手术：缝合法止血，而不能行胃壁切开止血，会加重出血。因此应激性溃疡出血时错误的治疗是行胃壁切开电灼止血（E错，为本题正确答案）。使用H₂受体拮抗剂（A对）、使用胃黏膜保护剂（B对）、经胃管灌注止血药物（C对）、胃镜下止血治疗（D对）均为应激性溃疡出血时可采用的治疗方法。